某女，32岁。产后瘀阻腹痛兼有热象，又见忧郁痞闷。宜选用的中药是
A. 月季花
B. 姜黄
C. 红花
D. 五灵脂
E. 西红花

正确答案：E。西红花

解析：本题考查西红花的主治病证。宜选用的中药是西红花（E对）。西红花【主治病证】（1）血滞闭经、痛经，产后瘀阻腹痛，癥瘕积聚，跌打伤痛。（2）热入营血，温毒发斑。（3）忧郁痞闷，惊悸发狂。月季花（A错）【主治病证】（1）月经不调，痛经，闭经。（2）肝郁之胸胁胀痛。姜黄（B错）【主治病证】（1）气滞血瘀所致的胸胁刺痛、闭经、痛经。（2）跌打瘀痛，风湿痹痛，肩臂痛。（3）疮肿。红花（C错）【主治病证】（1）血滞闭经、痛经，产后恶露不尽。（2）胸痹心痛，癥瘕积聚，跌打肿痛。（3）斑疹色暗（配清热凉血解毒药）。五灵脂（D错）【主治病证】（1）血滞痛经、闭经，产后瘀阻腹痛，胸胁脘腹刺痛。（2）瘀滞崩漏。（3）蛇虫咬伤。